患儿，2岁。面色少华，不思纳食，精神正常，舌苔薄腻。其治法是
A. 健脾益气
B. 和脾助运
C. 消食和中
D. 消补兼施
E. 养胃育阴

正确答案：B。和脾助运

解析：患儿不思纳食，当属厌食，脾失健运，脾气通于口，脾不和则口不知五味，不思纳食，气血化生不足，不能荣养颜面，故见面色萎黄少华，治宜和脾助运（B对）。健脾益气用于厌食之脾胃气虚证，症见不思进食，食而不化，大便溏薄夹不消化食物，面色少华，形体偏瘦，肢倦乏力（A错）。消食和中用于积滞之乳食内积证，症见不思乳食，嗳吐酸腐或呕吐食物、乳片，脘腹胀满疼痛，大便酸臭，烦躁啼哭（C错）。消补兼施用于积滞之脾虚夹积证，症见面色萎黄，形体消瘦，神疲肢倦，不思乳食，食则饱胀，腹满喜按，大便稀溏酸腥（D错）。养胃育阴用于厌食之脾胃阴虚证，症见不思进食，食少饮多，皮肤失润，大便偏干，小便短黄，甚或烦躁少寐，手足心热（E错）。